下列病毒中，能引起潜伏感染的是
A. 麻疹病毒
B. 狂犬病毒
C. 水痘-带状疱疹病毒
D. 脊髓灰质炎病毒
E. 甲型肝炎病毒

正确答案：C。水痘-带状疱疹病毒

解析：本题考查潜伏性感染。能引起潜伏感染的是水痘-带状疱疹病毒（C对）。潜伏性感染又称潜在性感染。病原体感染人体后，寄生于某些部位，由于机体免疫功能足以将病原体局限化而不引起显性感染，但又不足以将病原体清除时，病原体便可长期潜伏起来，待机体免疫功能下降时，则可引起显性感染。常见的潜伏性感染有单纯疱疹病毒、水痘病毒、疟原虫和结核杆菌等感染。潜伏性感染期间，病原体一般不排出体外，这是与病原携带状态不同之处潜伏性感染并不是在每种传染病中都存在。麻疹病毒（A错）可引起麻疹，狂犬病毒（B错）可引起狂犬病，脊髓灰质炎病毒（D错）可引起脊髓灰质炎，甲型肝炎病毒（E错）可引起甲型肝炎，均不会引起潜伏感染。